卫生毒理学体外试验常选用
A. 大鼠和小鼠
B. 果蝇
C. 游离器官、细胞、细胞器
D. 鸟类
E. 鱼类

正确答案：C。游离器官、细胞、细胞器